患者吐血缠绵不止，时轻时重，血色黯淡，神疲乏力，心悸气短，面色苍白，舌质淡，脉细弱。其治法是
A. 健脾和胃，宁络止血
B. 和中宁络，凉血止血
C. 益气养阴，宁络止血
D. 健脾益气，摄血止血
E. 健脾升阳，化瘀止血

正确答案：D。健脾益气，摄血止血

解析：脾气亏虚，统摄无权，血液外溢，故吐血缠绵不止，时轻时重，血色黯淡；脾气本已虚衰，加之反复出血，气随血出，气血亏虚，无以濡养脏腑，心失所养，则神疲乏力，心悸气短；血虚不能上荣于面，则面色苍白；舌质淡，脉细弱，均为气血亏虚之征，治法为健脾益气摄血，代表方为归脾汤（D对）（ABCE错）。